下列有关遗传性牙本质发育不全防治的叙述中，正确的是
A. 前牙最好用甲冠修复
B. 后牙可选择铸造金属冠
C. 患者应接受广泛的牙齿护理
D. 必要时做活动义齿或（牙合）垫修复
E. 以上说法均正确

正确答案：E。以上说法均正确

解析：预防由于磨耗造成的釉质和牙本质丧失，前牙最好用甲冠修复，甲冠为塑料制成的全冠修复体；后牙可选择铸造金属冠，必要时做活动义齿或（牙合）垫修复。患者应接受广泛的牙齿护理，预防患牙折裂。牙齿做冠预备时，要十分小心。如果应用局部修复体修复时，制作尤为谨慎，因为修复体可能对牙齿产生应力易使牙根折断。掌握“遗传性牙本质发育不全”知识点。